脾胃虚寒者慎用
A. 川楝子
B. 檀香
C. 枳实
D. 木香
E. 沉香

正确答案：A。川楝子

解析：川楝子有毒，不宜过量或持续服用，又因性寒，脾胃虚寒者慎用（A对）。檀香阴虚火旺，实热吐血者慎用（B错）。枳实孕妇慎用（C错）。木香的使用注意不详（D错）。沉香的使用注意不详（E错）综上可知脾胃虚寒者慎用的中药是川楝子。